是常染色体显性遗传的疾病
A. 白斑
B. 牙龈炎
C. 白皱病
D. 青春期牙周炎
E. 色盲

正确答案：C。白皱病

解析：本题考查白色海绵状斑痣。白皱病又称为家族性白色皱褶黏膜增生，为常染色体显性遗传（C对）。白斑是发生于口腔黏膜上以白色为主的损害，不能擦去，也不能去临床个别组织病理学的方法诊断为其他可定义的损害，属于癌前病变，其发病与局部刺激因素以及某些全身因素有关（A错）。青春期牙周炎局部因素主要为特异性细菌的感染，全身因素主要是机体防御能力缺陷，特别是患者周围血的中性多形核白细胞趋化功能的异常，若同时存在其他的局部因素，则可加重病情的发展（D错）。牙龈炎的使动因子是菌斑（B错）。色盲遗传方式是X连锁隐性遗传（E错）。